极性大，不进入血脑组织，副作用小的胃动力药是
A. 甲氧氯普胺
B. 多潘立酮
C. 伊托必利
D. 莫沙必利
E. 格拉司琼

正确答案：B。多潘立酮

解析：本题考查多潘立酮。多潘立酮（B对）的极性较大，不能透过血脑屏障，中枢神经系统的副作用较小；甲氧氯普胺（A错）易透过血脑屏障，易引起锥体外系副作用；伊托必利（C错）在中枢神经系统分布少，无严重的不良反应；莫沙必利（D错）为选择性5-羟色胺4（5-HT₄）受体激动药，能促进乙酰胆碱的释放，刺激胃肠道而发挥促动力作用，不会引起锥体外系综合征及心血管不良反应；格拉司琼（E错）是一种高选择性的5-HT₃受体拮抗剂，选择性高，无锥体外系、镇静等副作用。